患儿，10岁。急性肾炎，血压140/100mmHg，水肿明显，尿量明显减少，呼吸困难不能平卧，心率：140次/分，心音低钝，肝肋下2cm，X线胸片：肺纹理增强，该患儿可能出现
A. 肺炎
B. 高血压脑病
C. 肾功能衰竭
D. 循环充血
E. 支气管炎

正确答案：D。循环充血

解析：该患儿患有急性肾炎，血压升高，水肿明显，尿量明显减少，呼吸困难不能平卧，心率加快，心音低钝，肝大，X线示肺纹理增强。提示循环和肺循环的淤血，可能为肾炎出现肾功能不全导致水钠潴留而造成，因此该患儿可能出现充血性心衰（D对）。